下列处方中各润湿剂为
A. 醋酸氢化可的松微晶  25g
B. 氯化钠8g
C. 吐温3.5g
D. 羧甲基纤维素钠5g
E. 硫柳汞0.01g/制成1000ml

正确答案：C。吐温3.5g

解析：本题考查混悬剂。吐温3.5g（C对）为常用的润湿剂，HLB在7～11之间的表面活性剂，如磷脂类、泊洛沙姆、聚山梨酯类（商品名为吐温）。吐温为非离子型表面活性剂，广泛用作乳化剂和润湿剂。氢化可的松（A错）为主药。氯化钠（B错）为渗透压调节剂，减小对眼黏膜的刺激性。常用的合成或半合成高分子混悬剂有甲基纤维素、羧甲基纤维素钠（D错）等。硫柳汞（E错）为防腐剂。